男，渔民，发热1～2天，最高38.8℃，伴腹痛腹泻，3～5次/天，白细胞11×10⁹/L，N0.52，L0.13。2周尿培养正常。下一步检查应为
A. 血培养
B. 尿培养
C. 大便培养
D. 大便涂片
E. 钩体血清学检查

正确答案：E。钩体血清学检查

解析：男，渔民，考虑诊断为钩端螺旋体病，2周尿培养正常（提示患者肾脏未受感染），下一步检查应为钩体血清学检查（E对），其中的MAT，1次凝集效价≥1:400，或早、晚期两份血清比较，效价增加4倍即有诊断意义。血培养（A错）一般于钩端螺旋体病发病一周内抽血培养。尿培养（B错）正常，一般不再进行尿培养，常规用于检测尿液中引起感染的细菌等微生物。大便培养（C错）一般用于检测霍乱等疾病。大便涂片（D错）一般用于检测蠕虫、原虫感染等疾病。